有关磺胺类抗菌活性最敏感的是
A. 诺卡菌属
B. A群链球菌
C. 肺炎链球菌
D. 淋病奈瑟菌
E. 以上说法均正确

正确答案：E。以上说法均正确

解析：磺胺类对大多数革兰阳性菌和阴性菌有良好的抗菌活性，其中最敏感的是A群链球菌、肺炎链球菌、脑膜炎奈瑟菌、淋病奈瑟菌、鼠疫耶氏菌和诺卡菌属。掌握“磺胺类及甲硝唑”知识点。